我国目前使用的空气质量指数AQI为101～150时，空气质量状况为
A. 优
B. 良
C. 轻度污染
D. 中等污染
E. 重污染

正确答案：C。轻度污染

解析：本题考查空气质量指数的相关内容。我国目前使用的空气质量指数AQI为101～150时，空气质量状况为轻度污染（C对ABDE错）。